女，50岁。高热，寒战5天，意识模糊1天。既往体健。查体：T39℃，P120次/分，R22次/分，BP80/50mmHg，皮肤散在出血点和瘀斑，双肺未见异常，心率120次/分，律齐，腹软，肝肋下0.5cm，脾肋下及边。检查：Hb100g/L，WBC25.3×10⁹/L，血培养示大肠埃希菌生长，PT18秒（正常对照13秒），INR2.1，血纤维蛋白原定量108g/L。诊断为大肠埃希菌败血症，可能合并DIC。下列能反映DIC纤溶情况的检查是
A. 血纤维蛋白原测定
B. 凝血因子Ⅷ测定
C. PC、PS测定
D. AT-Ⅲ测定
E. D二聚体测定

正确答案：E。D二聚体测定

解析：DIC的本质是微血管血栓形成，其血栓的主要成分是纤维蛋白，纤维蛋白在纤溶系统纤溶酶的作用下可降解为可溶性纤维蛋白降解产物，包括D-二聚体、FDP，故D-二聚体测定（E对）、血浆FDP测定可反映纤溶情况。血纤维蛋白原测定（P610）（A错）主要反映共同凝血途径的功能；凝血因子Ⅷ：C活性测定（P606）（B错）主要反映内源性凝血功能；PC（蛋白C）、PS（蛋白S）测定（P606）（C错）、AT-Ⅲ（抗凝血酶-Ⅲ）测定（P606）（D错）主要反映抗凝血系统功能。